女，55岁。因反复失眠多梦3个月就诊，现夜难入眠，兼头重，胸脘满闷，心烦口苦，头晕目眩，痰多，大便不爽，舌红苔黄腻，脉滑其方剂最佳选择为
A. 归脾汤
B. 黄连阿胶汤
C. 半夏秫米汤
D. 龙胆泻肝汤
E. 黄连温胆汤

正确答案：E。黄连温胆汤

解析：本题不寐患者因宿食停滞，土壅木郁，肝胆不疏，因郁致热，生痰生热，痰热上扰，故不寐心烦，口苦目眩；痰热郁阻，气机不畅，胃失和降，则头重，胸脘满闷；痰湿蕴结大肠则大便不爽；舌红，苔黄腻，脉滑数，均是痰热之象，应当清化痰热，和中安神，方用黄连温胆汤加减（E对）。归脾汤（A错）用于心脾两虚证，以补养心脾，以生气血。黄连阿胶汤（B错）用于心肾不交证，以滋阴降火，交通心肾。半夏秫米汤（C错）用于主治痰饮内阻证以化痰和胃。龙胆泻肝汤（D错）肝郁化火证，以清肝泻火，佐以安神。